女，28岁。发热，咳嗽两个月。胸部X线片示左上肺不规则片状阴影。予抗结核治疗一月余。查体：T36.5℃，巩膜稍黄染，双肺未闻及干湿啰音。WBC4.3×10⁹/L，N0.55。肝功能检查示ALT、AST正常。总胆红素40.6umol/l，直接胆红素17.8umol/l。该患者现停用的药物是
A. 利福平
B. 异烟肼
C. 吡嗪酰胺
D. 乙胺丁醇
E. 链霉素

正确答案：A。利福平

解析：患者青年女性，发热，咳嗽两个月，胸部X线片示左上肺不规则片状阴影，抗结核治疗有效，因此该病例为肺结核患者。予抗结核治疗后出现肝脏损害前兆：巩膜稍黄染，总胆红素40.6μmol/l（正常值为1.71～21μmol/l）；直接胆红素17.8μmol/l（正常值为0～32μmol/l），口服利福平后，药物集中在肝脏，主要经胆汁排泄，现在已经出现肝功能损害，故应立即停用利福平（A对）。异烟肼副作用常有周围神经炎，偶有肝功能损害；乙胺丁醇副作用常有球后视神经炎；链霉素副作用常有听力障碍、眩晕、肾功能损害；吡嗪酰胺的主要不良反应为肠道不适、高尿酸血症、关节痛、肝功能损害。异烟肼（B错）、乙胺丁醇（D错）、链霉素（E错）、吡嗪酰胺（C错）对肝功能的影响并不明显。